下列各项，不属于弦脉所主的病证是
A. 肝郁
B. 胃热
C. 诸痛
D. 痰饮
E. 疟疾

正确答案：B。胃热

解析：胃热邪热亢盛，气血运行加速，故见数脉（B错，为本题正确答案）。寒热诸邪、痰饮内停、情志不遂、疼痛等，均可使肝失疏泄，气机郁滞，血气敛束不伸，脉管失去柔和之性，弹性降低，紧张度增高，故脉来强硬而为弦。疟疾由于疟邪伏于半表半里，少阳枢机不利而见弦脉（ACDE对）。